某女，45岁。患有类风湿性关节炎，长期服用解热镇痛药，近期咽喉肿痛，牙痛，邻居介绍服用新癀片。患者购药时像药师咨询，希望了解该药的更多信息。要是询问患者一般情况和用药目的后，结合病人既往治疗情况，阻止了该患者购买新癀片。接着，药师向患者介绍，服用该药的注意事项，正确的是
A. 孕妇慎用
B. 肝肾功能不全患者慎用
C. 哺乳期妇女慎用
D. 精神病患者慎用
E. 溃疡病患者慎用

正确答案：B。肝肾功能不全患者慎用

解析：本题考查的是吲哚美辛的使用注意。服用吲哚美辛的注意事项，正确的是肝肾功能不全患者慎用（B对）。常见的不良反应包括如下几个方面。（1）胃肠道反应：如恶心、呕吐、厌食、消化不良、胃炎、腹泻，偶有胃溃疡、穿孔、出血。（2）中枢神经系统反应：头痛、眩晕、困倦，偶有惊厥、周围神经痛、晕厥、精神错乱等。（3）造血系统损害：可有粒细胞、血小板减少，偶有再生障碍性贫血。（4）过敏反应：常见为皮疹、哮喘、呼吸抑制、血压下降等。（5）可引起肝肾损害。鉴此，溃疡病（E错）、哮喘、帕金森病和精神病患者（D错）以及孕妇（A错）、哺乳期（C错）妇女禁用；14岁以下儿童一般不用；老年患者及心功能不全、高血压、肝肾功能不全、出血性疾病患者慎用；且不宜与阿司匹林、丙磺舒、钾盐、氨苯蝶啶合用。